黏液囊肿好发于
A. 下唇及舌尖腹侧
B. 下唇及舌边缘侧
C. 上唇及口腔底部
D. 上唇及舌边缘侧
E. 发生无规律

正确答案：A。下唇及舌尖腹侧

解析：黏液囊肿是最常见的小唾液腺瘤样病变，好发于下唇及舌尖腹侧，这是因为舌体运动常受下前牙摩擦以及自觉或不自觉地咬下唇动作使黏膜下腺体受伤。掌握“舌下腺及唾液腺黏液囊肿”知识点。